男，44岁，建筑工人，6小时前不慎从高处坠落摔伤，腰部疼痛，活动受限，不能站立行走。为明确有无合并神经损伤，最有意义的体格检查是
A. 逐个棘突按压
B. 椎旁肌按压
C. 直腿抬高试验
D. 腰部过伸过屈
E. 双下肢感觉运动

正确答案：E。双下肢感觉运动

解析：患者从高处坠落摔伤（腰椎骨折常见原因）后，腰部疼痛、活动受限、不能站立行走（腰椎骨折可疑表现），结合患者病史和临床表现，应诊断为腰椎骨折。神经损伤后所支配的肌肉呈弛缓性瘫痪，主动运动、肌张力和腱反射均消失；所支配区域的皮肤感觉（触、痛和温度觉）也消失，故为为明确有无合并神经损伤，最有意义的体格检查是双下肢感觉运动（E对）。逐个棘突按压（A错）、椎旁肌按压（B错）主要用于检查脊柱有无骨折。直腿抬高试验（C错）主要用于诊断腰椎间盘突出。患者怀疑腰部骨折，不可行腰部过伸过屈（D错）检查，以免加重损伤程度。